蝶鞍包括
A. 垂体窝和鞍背
B. 垂体窝和蝶窦
C. 垂体窝和斜坡
D. 垂体窝和颈动脉沟
E. 无

正确答案：A。垂体窝和鞍背

解析：垂体窝和鞍背统称蝶鞍，其两侧浅沟为颈动脉沟（A对）。